新清宁片主治
A. 阳虚便秘
B. 血虚便秘
C. 阴虚便秘
D. 气虚便秘
E. 实热便秘

正确答案：E。实热便秘

解析：本题考查的是新清宁片的主治。新清宁片主治实热便秘（E对）。新清宁片【主治】内结实热，喉肿，牙痛，目赤，便秘，下痢，感染性炎症，发烧等。苁蓉通便口服液【主治】气伤血亏，阴阳两虚所致便秘（AC错）。芪蓉润肠口服液【主治】气阴两虚（D错），脾肾不足所致便秘。